普通型流脑的表现，下列哪项是不典型症状
A. 头痛
B. 呕吐
C. 出血点
D. 抽搐
E. 巴宾斯基征阳性

正确答案：E。巴宾斯基征阳性

解析：普通型流脑：前驱期主要表现为低热，咽喉肿痛，鼻咽部黏膜充血和分泌物增多等上呼吸道感染症状；败血症期，突然寒战，高热，伴头痛（A对），呕吐（B对），肌肉酸痛等，大多数患者，发病数小时后全身皮肤、黏膜出现出血点（C对），直径1mm～1cm，严重者瘀点、瘀斑数量迅速增多、扩大，形成大片坏死或血疱，结膜可有充血；脑膜炎期，头痛欲裂，颈痛，呕吐频繁呈喷射性，血压增高而脉搏减慢，狂躁不安，谵语及惊厥，并出现颈项强直、抽搐（D对）、克氏征及布氏征阳性等脑膜刺激征。巴宾斯基征阳性（E错，为本题正确答案）是普通型流脑的不典型症状。